恶性多形性腺瘤典型的临床表现是
A. 疼痛
B. 溃疡
C. 面瘫
D. 精神症状
E. 生长突然加快

正确答案：E。生长突然加快

解析：恶性多形性腺瘤典型的临床表现是长期存在的肿块生长突然加快，如果浸润神经和周围组织，可伴有疼痛、面瘫、固定和溃疡形成。掌握“基底细胞腺瘤及恶性多形性腺瘤”知识点。